男孩，5岁，患有结核病，但结核菌素试验阴性，可能是
A. 合并上呼吸道感染
B. 抗结核治疗1周
C. 接种白百破三联疫苗后
D. 粟粒型肺结核
E. 颈淋巴结结核

正确答案：D。粟粒型肺结核